直肠癌的最初症状是
A. 便血
B. 腹痛
C. 消瘦
D. 大便变细或变形
E. 排便习惯改变

正确答案：E。排便习惯改变

解析：直肠癌的最初症状是排便习惯改变（E对）。癌肿生长到一定程度便会出现其他症状（ABCD错）。